张某，女，23岁。患尖锐湿疣，外生殖器及肛门出现疣状赘生物、色灰，质柔软，表面秽浊潮湿，触之易出血，恶臭，小便色黄，不畅，舌苔黄腻，脉弦数。治拟利湿化浊，清热解毒。应首选
A. 黄连解毒汤
B. 萆薢化毒汤
C. 龙胆泻肝汤
D. 知柏地黄丸
E. 土茯苓合剂

正确答案：B。萆薢化毒汤

解析：尖锐湿疣的特点是以皮肤黏膜交界处，尤其是外阴、肛周出现淡红色或污秽色表皮赘生物为主要表现。湿毒下注，则可见外生殖器及肛门出现疣状赘生物，湿毒困阻气机，则见小便黄，不畅，舌苔黄腻，脉弦数均为湿毒之象。当利湿化浊，清热解毒，用萆薢化毒汤（B对）。黄连解毒汤适用于湿热毒蕴证的尖锐湿疣。两者鉴别点在于湿热毒蕴型赘生物表面可见大量黄色分泌物，伴瘙痒（A错）。龙胆泻肝汤具有清泻肝胆实火，清利肝经湿热之功效，适用于梅毒或者淋病的肝经湿热证（C错）。知柏地黄丸具有滋阴清热之功，适用于阴虚毒恋的淋病。土茯苓合剂功可清热凉血解毒，适于治疗梅毒（E错）。